以下不是引起ALI/ARDS的肺内因素的是
A. 化学因素，如吸入毒气
B. 物理因素，如放射性损伤
C. 生物性因素，如重症肺炎
D. 严重休克
E. 肺部放射性损伤

正确答案：D。严重休克

解析：不是引起ALI/ARDS的肺内因素的是严重休克（D错，为本题正确答案），严重休克属于肺外因素。毒气（A对）、放射性损伤（B对）、重症肺炎（C对）、肺部放射性损伤（E对）都属于肺内因素，此外还有肺挫伤、淹溺、肺栓塞、氧中毒。